属于食品中天然放射性物质的是
A. ³H
B. ⁸⁹Sr
C. ¹³¹I
D. ⁴⁰K
E. ¹³⁷Cs

正确答案：D。⁴⁰K

解析：本题考查食品中的天然放射性物质。食物中主要的天然放射性物质有：⁴⁰K（D对ABCE错）、²²⁶Ra、²¹⁰Po。